钩端螺旋体感染可引起
A. 黄疸出血症状
B. 咽峡炎
C. 关节炎及关节畸形
D. 脊髓痨及动脉瘤
E. 反复发热与缓解

正确答案：A。黄疸出血症状

解析：钩端螺旋体感染可引起黄疸出血症状（A对），临床病型为黄疸出血型。咽峡炎（B错）主要由柯萨奇A组病毒某些血清型引起（P254）。关节炎关节畸形（C错）多见于风湿性疾病。脊髓痨及动脉瘤（D错）可见于Ⅲ期梅毒，其病原体为苍白密螺旋体苍白亚种（梅毒螺旋体）（P204）。反复发热与缓解（E错）可见于疟疾，其病原虫为人类疟原虫（八版传染病学P280）。